初产妇，妊娠39周，骨盆各径线为：对角径13cm，坐骨棘间径9.5cm，坐骨结节间径7cm，耻骨弓角度80°。本例的骨盆诊断是
A. 扁平骨盆
B. 中骨盆狭窄
C. 漏斗骨盆
D. 均小骨盆
E. 畸形骨盆

正确答案：C。漏斗骨盆

解析：初产妇，骨盆各径线为：对角径13cm（正常值12.5～13cm），坐骨棘间径9.5cm（正常值为10cm），坐骨结节间径7cm（正常值为9cm），耻骨弓角度80°（漏斗骨盆坐骨棘间径和坐骨结节间径缩短），本例的骨盆诊断为漏斗骨盆（C对）。扁平骨盆（P191）（A错）常为骨盆入口平面狭窄，对角径＜11.5cm。本例除中骨盆狭窄（B错）外，同时有骨盆出口平面狭窄。均小骨盆（P192-P193）（D错）骨盆的三个平面径线均比正常值小。畸形骨盆（P193）（E错）是指骨盆失去正常形态及对称性。